营养素摄入量达到EAR的时候，发生营养素不足的概率为
A. 0
B. 0.1
C. 0.5
D. 0.75
E. 1

正确答案：C。0.5